小儿3个脊柱自然弯曲随韧带的发育而固定是在
A. 3个月
B. 6个月
C. 9个月
D. 12个月
E. 6～7岁

正确答案：E。6～7岁

解析：至6～7岁时3个脊柱自然弯曲才随韧带的发育而固定。掌握“骨骼发育”知识点。